前列腺增生症患者，小便自溢，精神萎靡，腰酸膝软，面色白，畏寒喜暖，舌淡苔薄白，脉沉细。其证型是
A. 阴虚火旺
B. 湿热下注
C. 肾阳不足
D. 气血瘀滞
E. 中气下陷

正确答案：C。肾阳不足

解析：肾阳不足，阳虚不能鼓动精神，则精神萎靡。肾阳虚衰不能温养筋骨、腰膝，则腰膝膝软，畏寒喜暖。肾阳虚弱，固摄失司，则小便自溢。综上得出为上述证型为肾阳不足证（C对）。前列腺增生肾阴亏虚证（A错）多表现小便频数不爽，尿少热赤，或闭塞不通。头晕耳鸣，腰膝酸软，五心烦热， 大便秘结。舌红少津，苔少或黄，脉细数。前列腺增生湿热下注证（B错）多表现为小便频数黄赤，尿道灼热或涩痛，排尿不畅，甚或点滴不通，小腹胀满。或大便干燥，口苦口黏。舌暗红，苔黄腻，脉滑数或弦数。前列腺增生气滞血瘀证（D错）多表现为小便不畅，尿线变细或点滴而下，或尿道涩痛，闭塞不通，或小腹胀满隐痛，偶有血尿。舌质暗或有疲点瘀斑，苔白或薄黄，脉弦或淫。前列腺增生无中气下陷（E错）的证型。